大多数可经非手术治疗好转的是
A. 瘢痕性幽门梗阻
B. 胃十二指肠溃疡大出血
C. 胃十二指肠溃疡急性穿孔
D. 十二指肠溃疡并球部变形
E. 穿透性十二指肠溃疡

正确答案：B。胃十二指肠溃疡大出血

解析：胃十二指肠溃疡大出血（B对）患者大多数可经非手术治疗好转，一般经止血、治酸药物及内镜治疗可达到止血目的。瘢痕幽门梗阻（A错）为永久性梗阻，不可逆。需要手术治疗，恢复胃肠的连续性，解除梗阻，通常选用胃大部分切除术。胃十二指肠溃疡急性穿孔（C错）是胃十二指肠溃疡严重并发症也是外科常见的急腹症，主要的治疗方法仍是手术治疗，根据患者情况结合手术条件选择单纯穿孔修补术或彻底性溃疡手术。十二指肠溃疡并球部变形（D错）及穿孔穿透性十二指肠溃疡（E错）内科治疗效果差，易有并发症，需手术治疗。